表现为硬下疳的疾病是
A. 淋病
B. 一期梅毒
C. 二期梅毒
D. 三期梅毒
E. 尖锐湿疣

正确答案：B。一期梅毒

解析：一期梅毒的特征性表现为硬下疳（B对）。二期梅毒（C错）有皮疹、骨关节病变、眼部病变、神经系统病变及其他脏器病变等多系统表现，在肛周、阴唇、腹股沟、阴茎、大腿内侧等潮湿部位，常可见到扁平湿疣。三期梅毒（D错）有梅毒性树胶肿的非特异性肉芽肿样损害。淋病（A错）和尖锐湿疣（E错）都没有硬下疳。